男，35岁，会阴部骑跨伤，受伤后尿道外口滴血，伴尿时疼痛加重，会阴部和阴囊处轻度肿胀、瘀斑。该患者泌尿系损伤的部位是
A. 尿道阴茎部
B. 膀胱颈部
C. 尿道膜部
D. 尿道球部
E. 尿道前列腺部

正确答案：D。尿道球部

解析：青年男性患者，会阴部骑跨伤（提示可能有前尿道损伤）后尿道外口滴血，伴尿时疼痛加重，会阴部和阴囊处轻度肿胀、瘀斑（前尿道损伤典型表现），结合患者病史和临床表现，考虑该患者泌尿系损伤的部位是前尿道损伤，最多见于尿道球部（D对）。尿道阴茎部（P530）（A错）损伤较少见，多由弹片、锐器所致，开放性损伤多见。膀胱颈部（B错）多为医源性损伤所致。尿道膜部（P531）（C错）和尿道前列腺部（E错）损伤多由于骨盆骨折所导致，常表现为休克、疼痛及耻骨后间隙和膀胱周围的尿液外渗。